下列不支持艾滋病诊断的是
A. 口咽念珠菌感染
B. 持续发热
C. 头痛、进行性痴呆
D. 皮肤黏膜出血
E. 慢性腹泻

正确答案：D。皮肤黏膜出血

解析：当HIV抗体阳性时，反复发作的口腔白念珠菌感染（A对）、持续发热（B对）、头痛、进行性痴呆（C对）、慢性腹泻（E对）均支持艾滋病的诊断。艾滋病对皮肤和黏膜造成的损害主要是肿瘤和感染等，并不出现出血症状，故皮肤黏膜出血（D错，为本题正确答案）并不能作为艾滋病诊断的依据。